脑死亡标准的伦理意义不包括
A. 科学地判定死亡
B. 能够及时地抢救假死状态的病人，维护人的生命
C. 有利于节约卫生资源
D. 直接地达到开展器官移植的目的
E. 体现了对生命的尊重

正确答案：D。直接地达到开展器官移植的目的

解析：脑死亡和器官移植是两个独立的伦理问题，执行脑死亡标准有利于器官移植的开展，但不以开展器官移植为直接目的。掌握“安乐死与死亡伦理”知识点。